女，15岁。1周前体检时发现心律不齐。平素无不适，活动耐力正常。查体：P56次／分。心率随呼吸节律明显变化，吸气时心率加快，呼气时减慢。心电图示窦性心率，RR间期不等，最长RR间期与最短RR间期之差大于0.12秒。该患者的心律不齐提示
A. 急性心肌炎
B. 心血管神经症
C. 房室传导阻滞
D. 病态窦房结综合征
E. 无病理意义

正确答案：E。无病理意义

解析：患者青少年女性，1周前体检时发现心律不齐，无其他明显症状。查体：P56次/分（正常60～100次/分）。心率随呼吸节律明显变化，吸气时心率加快，呼气时减慢，RR间期不等，最长RR间期与最短RR间期之差大于0.12秒（提示窦性心律不齐）。结合患者年龄、症状及体征，该患者无明显异常，心律不齐提示无病理意义（E对）。急性心肌炎（A错）在发病前1～3周常有病毒感染前驱症状，如发热、乏力、肌肉酸痛或恶心呕吐等消化道症状，临床表现以心律失常为主，以房性与室性期前收缩及房室传导阻滞多见。心血管神经症（B错）患者无器质病变性心血管疾病和精神心理问题共存，多见于更年期妇女（P331）。病态窦房结综合征（D错）患者窦房结有器质性变化，主要表现为自发持续而显著的窦性心动过缓（50次/分以下）。